舌下片的崩解时限是
A. 60秒
B. 5分钟
C. 1小时
D. 30分钟
E. 15分钟

正确答案：B。5分钟

解析：本题考查崩解时限检查法。舌下片要求在5分钟内（B对）全部崩解并溶化。